可致驾驶员嗜睡、神志低沉的是
A. 东莨菪碱
B. 氯苯那敏
C. 阿米洛利
D. 阿司匹林
E. 亚叶酸钙

正确答案：B。氯苯那敏

解析：本题考查驾驶员用药。氯苯那敏（B对）服用后可引起嗜睡和反应能力降低而影响驾驶员安全。东莨菪碱（A错）可扩大瞳孔，持续3～5d，出现视物不清。阿米洛利（C错）不良反应为口渴、头晕、视力改变。阿司匹林（D错）不良反应常见的有恶心、呕吐、上腹部不适或疼痛等胃肠道反应。亚叶酸钙（E错）不良反应少见，偶见皮疹、荨麻疹或哮喘等过敏反应。